东莨菪碱
A. 具发汗、平喘作用
B. 具抗菌作用
C. 具镇痛作用
D. 具镇静麻醉作用
E. 具消肿利尿抗肿瘤作用

正确答案：D。具镇静麻醉作用

解析：本题考查的是洋金花中生物碱的药理作用。东莨菪碱具镇静麻醉作用（D对）。洋金花中生物碱的药理作用：莨菪碱及其外消旋体阿托品有解痉镇痛、解有机磷中毒和散瞳作用；东莨菪碱除具有莨菪碱的生理活性外，还有镇静、麻醉作用。具发汗、平喘作用（A错）的是麻黄碱。麻黄碱有发汗、平喘、镇咳等作用。具抗菌作用（B错）的是小檗碱。小檗碱具有抗菌、抗病毒、抗毒素、抗腹泻、解热、抗炎、降血糖等作用。具镇痛作用（C错）的是延胡索乙素。延胡索乙素有镇痛、镇静、抗心肌缺血、抗脑缺血、抗血栓等作用。具消肿利尿抗肿瘤作用（E错）的是苦参碱。苦参总生物碱具有抗肿瘤、抗病原微生物、抗心律失常、解热、抗炎、抗变态反应和调节免疫等作用。